轴面上从牙尖顶端伸向牙颈的纵行隆起，称为
A. 三角嵴
B. 斜嵴
C. 切嵴
D. 轴嵴
E. 颈嵴

正确答案：D。轴嵴

解析：轴嵴：是轴面上从牙尖顶端伸向牙颈的纵行隆起。尖牙唇面的轴嵴称为唇轴嵴；后牙颊面的轴嵴称为颊轴嵴；尖牙及后牙舌面的轴嵴称为舌轴嵴。掌握“牙的萌出、更替及牙体解剖名词、标志”知识点。